内囊区出血的表现是
A. 高热
B. 抽搐
C. “三偏”征
D. 脑膜刺激征明显
E. 脑脊液大多正常

正确答案：C。“三偏”征

解析：丘脑出血（内囊内侧型)的体征是对侧偏瘫、偏盲、偏身感觉障碍，即“三偏”征（C对），脑脊液为血性（E错），常无高热（A错）、脑膜刺激征（D错）及抽搐（B错）。